左心室肥大的心电图可表现为
A. RV₁＞1.0mVRV₁+SV₅＞1.2mV
B. V₃V₄导联呈RS型，R/S接近于1
C. V₅V₆导联以R波为主，R/S＞1，RV₅＜2.5mV
D. V₁至V₅，R波逐渐增大，而S波逐渐变小
E. RV₅＞2.5mV，V₁或RV₅+SV₁＞3.5～4.0mV

正确答案：E。RV₅＞2.5mV，V₁或RV₅+SV₁＞3.5～4.0mV

解析：左心室肥大的心电图特点是：①左心室高电压：胸导联：RV₅＞2.5mV，RV₅+SV₁＞4.0mV（男性）或＞3.5mV（女性）；肢体导联：R1＞1.5mV，RaVL＞1.2mV，RaVF＞2.0mV，RⅠ+SⅢ＞2.5mV（E对BD错）。②QRS波群时间轻度延长达0.10～0.11s，但一般＜0.12s，V₅导联R峰时间＞0.05s。③心电轴左偏，多数≤30°。④继发性ST-T改变：在V₅、V₆等以R波为主的导联中，ST段下移＞0.05 mV，T波低平、双向或倒置（C错）。RV₁＞1.0mVRV₁+SV₅＞1.2mV为右心室肥大心电图（A错）。